呋塞米不应与哪一药物合用
A. 氢氯噻嗪
B. 头孢呋辛
C. 头孢他啶
D. 维生素K
E. 鱼精蛋白

正确答案：B。头孢呋辛

解析：本题考查头孢菌素类抗生素。呋塞米不应与头孢呋辛（属于第二代头孢菌素）（B对）合用，因第二代头孢菌素有一定的肾毒性，与呋塞米这样的强利尿剂可加重肾损害。氢氯噻嗪（A错）属于噻嗪类利尿剂，可用于各种原因引起的水肿、高血压病、肾性尿崩症等。。头孢他啶（C错）属于第三代头孢菌素，对G+菌的作用不及第—、二代，对G-菌包括肠杆菌类铜绿假单胞菌及厌氧菌有较强的作用，对β-内酰胺酶有较高的稳定性，可用于危及生命的败血症、脑膜炎肺炎、骨髓炎及尿路严觅感染的治疗，能有效控制严重的铜绿假单胞菌感染。维生素K（D错）缓慢大剂量静脉注射可用于香豆素类药物（双香豆素、华法林等）用量过大引起出血的抢救。鱼精蛋白（E错）可用于抢救肝素使用过量引起的出血。